标签必须印有专有标识的药品是
A. 白蛋白
B. 福尔可定
C. 头孢哌酮
D. 氧氟沙星
E. 鱼腥草注射液

正确答案：B。福尔可定

解析：本题考查药品标签管理。标签必须印有专有标识的药品是福尔可定（B对）。福尔可定被列入麻醉药品品种目录管控。说明书和标签必须印有专用标识的药品包括麻醉药品、精神药品、医疗用毒性药品、放射性药品、外用药品和非处方药品。